关于普萘洛尔，哪项是错误的
A. 阻断突触前膜β2受体减少去甲肾上腺素释放
B. 减少肾素的释放
C. 长期用药一旦病情好转应立即停药
D. 生物利用度个体差异大
E. 能诱发支气管哮喘

正确答案：C。长期用药一旦病情好转应立即停药

解析：普萘洛尔有较强的β受体阻滞作用，能够与去甲肾上腺素能神经递质或肾上腺素受体激动剂竞争β受体，也通过阻断肾小球旁边的β受体而抑制肾素的释放，但对支气管的阻力有一定程度增高。不同个体口服相同剂量的普萘洛尔，血药浓度差异很大，属于治疗高血压的基础药物。高血压患者进行药物治疗时，需强调“终身服药”的意识。掌握“抗高血压药”知识点。